关于药物代谢的错误表述是
A. 药物代谢是药物在体内发生化学结构变化的过程
B. 参与药物代谢的酶通常分为微粒体酶系和非微粒体酶系
C. 通常代谢产物比原药物的极性小，水溶性差
D. 药物代谢主要在肝脏进行，也有一些药物肠道代谢率较高
E. 代谢产物比原药物更易于从肾脏排泄

正确答案：C。通常代谢产物比原药物的极性小，水溶性差

解析：本题考查药物代谢。药物代谢产物一般比原药物极性大、水溶性好（C错，为本题正确答案），更易于排出体外；药物的代谢一般伴随着化学结构上的变化（A对）；参与药物代谢的酶通常分为微粒体酶系和非微粒体酶系（B对）；药物代谢主要在肝脏进行（D对），胃肠道也参与代谢，有些药物在肠道的代谢率较高；药物代谢产物极性和水溶性变大，更易于从肾脏排泄（E对）。